男，23岁。间断脓血便2年，粪便成形或糊状，每日2～3次，有时里急后重，抗生素治疗无效。最可能诊断是
A. 溃疡性结肠炎
B. 克罗恩病
C. 慢性细菌性痢疾
D. 肠结核
E. 阿米巴肠炎

正确答案：A。溃疡性结肠炎

解析：青年男性患者，间断脓血便伴里急后重（溃疡性结肠炎的典型特点）2年，粪便成形或糊状，每日2～3次（＜4次/日为轻度腹泻），抗生素治疗无效（用于鉴别慢性细菌性痢疾），考虑诊断为溃疡性结肠炎（A对）。克罗恩病（P377）（B错）临床以腹痛、腹泻、体重下降、腹块、瘘管形成和肠梗阻为特点，粪便一般无脓血和黏液。慢性细菌性痢疾（C错）可有黏液脓血便伴里急后重，但抗生素治疗有效。肠结核（P368）（D错）分为溃疡型肠结核和增生型肠结核，溃疡型肠结核多有结核毒血症状，主要表现为腹泻，粪便呈糊样，多无脓血，不伴里急后重；增生型肠结核主要表现为腹部肿块与便秘。阿米巴肠炎（E错）可有腹泻，粪便不成形或稀便，混有黏液和未消化的食物，伴有恶臭，抗阿米巴治疗有效。